治疗高血脂宜选
A. 党参
B. 甘草
C. 黄芪
D. 冬虫夏草
E. 何首乌

正确答案：E。何首乌

解析：本题考查的是何首乌的药理作用。治疗高血脂宜选何首乌（E对）。何首乌的药理作用：（1）促进造血功能；（2）降血脂、抗动脉粥样硬化；（3）增强免疫功能。党参（A错）：【功效】补中益气，生津养血。【主治病证】（1）脾气亏虚之食欲不振、呕吐泄泻。（2）肺气亏虚之气短喘促、脉虚自汗。（3）气津两伤之气短口渴。（4）血虚萎黄，头晕心慌。甘草（B错）的药理作用：（1）抗溃疡。（2）镇咳、祛痰。（3）解毒。黄芪（C错）的药理作用：黄芪具有增强免疫功能，强心，扩张外周血管、冠状血管及肾血管，改善微循环，抑制血小板聚集等作用。冬虫夏草（D错）：【功效】益肾补肺，止血化痰。【主治病证】（1）肾虚之阳痿、腰膝酸痛。（2）肺肾两虚之久咳虚喘，肺阴不足之劳嗽痰血。